“鱼与熊掌不能兼得”的动机冲突属于
A. 双趋冲突
B. 双避冲突
C. 趋避冲突
D. 双重趋避冲突
E. 双趋双避冲突

正确答案：A。双趋冲突

解析：双趋冲突（A对）也称接近-接近式冲突｡两个目标具有相同的吸引力，引起同样强度的动机｡但由于受条件等因素的限制，无法同时实现，二者必择其一，即所谓‘鱼和熊掌不可兼得’｡双避冲突（B错）指一个人同时受到两种事物的威胁，产生同等强度的逃避动机，但迫于情势，必须接受其中一个，才能避开另一个，处于左右为难，进退维谷的紧张状态｡趋避冲突（C错）指一个人对同一事物同时产生两种动机，即向往得到它，同时又想拒绝和避开它｡双重趋避式冲突（D错）指人们常常会遇到多个目标，每个目标对自己都有利也都有弊，反复权衡拿不定主意所产生的冲突｡